关于楔束的描述，正确的是
A. 位于脊髓后索全长
B. 主要传导下肢的深感觉和精细触觉
C. 在脊髓后索中位于薄束的内侧
D. 属第二级感觉纤维束
E. 起于胸部T4以上的脊神经节细胞

正确答案：E。起于胸部T4以上的脊神经节细胞

解析：楔束主要传导躯干和四肢意识性本体感觉的精细触觉（B错）。在脊髓后索中位于薄束的外侧（C错），在脊髓后索内上行（A错），属第一级感觉纤维束（D错），起于胸部T4以上的脊神经节细胞（E对）。